不属于牙髓病临床分类的是
A. 可复性牙髓炎
B. 不可复性牙髓炎
C. 牙髓坏死
D. 牙髓退变
E. 牙内吸收

正确答案：D。牙髓退变

解析：本题考查牙髓病的临床分类。牙髓退变属于病理学分类，不属于临床分类（D错，为本题的正确答案）。牙髓变性可分为成牙本质细胞空泡变性、牙髓钙化、牙髓网状萎缩、牙髓纤维性变。可复性牙髓炎（A对）、不可复性牙髓炎（B对）、牙髓坏死（C对）、牙内吸收（E对）均属牙髓病的临床分类。